以下哪个解剖结构属于上颌骨
A. 腭突
B. 颞突
C. 翼突
D. 锥突
E. 喙突

正确答案：A。腭突

解析：喙突是下颌骨的解剖结构；翼突为一对从蝶骨体与大翼连接处伸向下方的突起，属于蝶骨的解剖结构；锥突为腭骨的解剖结构；颞突为颧骨的解剖结构。掌握“上颌骨解剖特点”知识点。